长期用广谱抗生素出现二重感染属于
A. 变态反应
B. 过敏反应
C. 继发反应
D. 毒性反应
E. 药物反应

正确答案：C。继发反应